水重吸收的量最多的部位是
A. 肾小囊
B. 近球小管
C. 髓袢
D. 远曲小管
E. 集合管

正确答案：B。近球小管